因长期食用镉米导致绝经期妇女和经产妇周身剧烈疼痛的痛痛病，首先受损的部位是
A. 骨骼
B. 肝脏
C. 胆囊
D. 肾脏
E. 膀胱

正确答案：D。肾脏

解析：本题考查痛痛病首先受损的部位。由于镉米中含有大量的镉元素，这种元素会被人体吸收，并通过血液运输到肾脏，在肾脏中积累，形成毒性物质，导致肾脏受损，从而引发痛痛病。因此，因长期食用镉米导致绝经期妇女和经产妇周身剧烈疼痛的痛痛病，首先受损的部位是肾脏（D对ABCE错）。